下列关于毒蛇咬伤的临床表现的描述，正确的是
A. 神经毒局部症状重，易被发现
B. 神经毒潜伏期短，吸收速度慢
C. 混合毒造成的死亡原因为神经毒
D. 血液毒潜伏期长，吸收速度快
E. 血液毒局部症状轻，全身症状出现晚

正确答案：C。混合毒造成的死亡原因为神经毒

解析：混合毒者有眼镜蛇、眼镜王蛇和蝮蛇，抑制运动神经末梢释放介质的作用，造成呼吸麻痹（C对）。神经毒毒蛇咬伤者潜伏期较长，多在伤后1～6小时出现症状，表现为头昏头痛、胸闷恶心、四肢乏力麻木、眼睑下垂，重者声音嘶哑、语言不利、呼吸困难、瞳孔散大、全身瘫痪、惊厥抽搐，终致呼吸麻痹而死亡。血液毒毒蛇咬伤者在短期内即出现全身中毒症状，恶寒发热、烦躁、口干、全身关节肌肉酸痛、腹痛、腹泻或大便秘结，重者可有广泛的皮下出血或瘀斑，以及内脏出血，如咯血、呕血、便血、尿血等，最终因循环衰竭、休克而死亡。混合毒毒蛇咬伤者兼见上述两种表现，混合毒造成死亡的主要原因仍为神经毒。值得注意的是神经毒的吸收速度快（B错），潜伏期较长，局部症状轻（A错），常易被忽视，一旦发作就急骤发展，并难以控制，危险性较大。血液毒引起的局部症状重，全身症状亦出现早（DE错），一般治疗较早，故死亡率较神经毒低。